男性，25岁，无症状，近日婚前检查发现HBsAg（+），来医院进一步做了HBV两对半，患者最关心的是有无传染性。下列指标中，代表有传染性的是
A. HBsAg
B. 抗-HBs
C. HBeAg
D. 抗-HBe
E. 抗-HBc

正确答案：C。HBeAg